根据《中华人民共和国药品管理法》，属于劣药的药品包括
A. 未标明有效期或更改有效期的药品
B. 不注明或者更改生产批号的药品
C. 擅自添加了防腐剂的药品
D. 擅自添加了辅料的药品
E. 使用未经批准的直接接触药品的包装材料和容器的药品

正确答案：A、B、C、D。未标明有效期或更改有效期的药品；不注明或者更改生产批号的药品；擅自添加了防腐剂的药品；擅自添加了辅料的药品

解析：本题考查劣药的界定。根据《中华人民共和国药品管理法》，属于劣药的药品包括未标明有效期或更改有效期的药品（A对）、不注明或者更改生产批号的药品（B对）、擅自添加了防腐剂的药品（C对）、擅自添加了辅料的药品（D对）。劣药的界定：根据《药品管理法》第九十八条第三款规定，有下列情形之一的，为劣药：①药品成分的含量不符合国家药品标准；②被污染的药品；③未标明或者更改有效期的药品；④未注明或者更改产品批号的药品；⑤超过有效期的药品；⑥擅自添加防腐剂、辅料的药品；⑦其他不符合药品标准的药品。